地震灾区饮水卫生措施中，控制肠道传染病介水传播最有效的措施是
A. 不喝生水
B. 保护水源
C. 饮水消毒
D. 水质混凝
E. 水质过滤

正确答案：C。饮水消毒

解析：本题考查灾区控制肠道传染病介水传播最有效的措施。地震灾区饮水卫生措施中，控制肠道传染病介水传播最有效的措施是饮水消毒（C对ABDE错）。饮用水的消毒方式包括集中式供水的消毒和分散式饮水的消毒，常用便于携带的消毒剂有：漂白粉类（漂白粉片、漂白粉精片）、有机氯胺类（氯胺T、清水龙）、氯氰脲酸类（二氯异氰尿酸钠、三氯异氰尿酸钠、氯溴异氰酸）等含氯消毒剂。